经批准可在普通商店和超市销售的是
A. 麻醉药品
B. 处方药
C. 甲类非处方药
D. 非处方药
E. 乙类非处方药

正确答案：E。乙类非处方药